桡神经最贴近骨面的部位是
A. 腋窝
B. 桡神经沟
C. 肱桡肌上端
D. 桡骨头背面
E. 肱骨上段

正确答案：B。桡神经沟

解析：桡神经最贴近骨面的部位是桡神经沟（B对）。